产科腹膜外剖宫术常在
A. 子宫底
B. 子宫体
C. 子宫峡
D. 子宫下段
E. 无

正确答案：C。子宫峡

解析：子宫峡（C对）壁在妊娠末期变薄，是产科腹膜外刨宫术的部位。